在产地加工需要“发汗”的药材有
A. 玄参
B. 续断
C. 人参
D. 厚朴
E. 杜仲

正确答案：A、B、D、E。玄参；续断；厚朴；杜仲

解析：本题考查的是发汗的药材。在产地加工需要“发汗”的药材有玄参（A对）、续断（B对）、厚朴（D对）、杜仲（E对）。发汗有些药材在加工过程中用微火烘至半干或微煮、蒸后，堆置起来发热，使其内部水分往外溢，变软，变色，增加香味或减少刺激性，有利于干燥。这种方法习称“发汗”。如厚朴、杜仲、玄参、续断等。人参（C错）【采收加工】园参多于秋季采挖，洗净，晒干或烘干。